历史性队列研究
A. 不适于发病率很低的疾病的病因研究
B. 不适于罕见暴露和疾病关系的病因研究
C. 不适于一果多因的研究
D. 目前确证暴露和疾病的因果关系最好的设计
E. 收集到的资料可能缺少需要的细目

正确答案：E。收集到的资料可能缺少需要的细目

解析：本题考查历史性队列研究的相关内容。研究对象的分组是根据研究开始时研究者已掌握的有关研究对象在过去某个时点的暴露状况的历史材料做出的；研究开始时研究的结局已经出现，不需要前瞻性观察，这样的设计模式称为历史性队列研究。该研究的缺点是资料积累时未受到研究者的控制，收集到的资料可能缺少需要的细目（E对ABCD错）。